关于循证医学的描述，下列选项错误的是
A. 随机对照试验及其系统综述的结论通常是最佳证据
B. 没有实验研究证据时不能实施循证医学
C. 循证医学适合于临床诊治，也适合于预防
D. 横断面研究证据有时还优于随机对照试验
E. 患者的意见是实践循证医学的重要考虑因素之一

正确答案：B。没有实验研究证据时不能实施循证医学

解析：本题考查循证医学的相关内容。循证医学是有意识地、明确地、审慎地利用现有最好的证据制定关于个体患者的诊治方案（C对）。现有最好的证据可以是医生的临床经验、过去的医学实践等，不一定非得是实验研究的证据（B错，为本题正确答案）。就干预措施效果而言，最可靠的证据是来自多个随机对照试验的系统综述（A对）。横断面研究证据有时还优于随机对照试验（D对）。患者的意见是实践循证医学的重要考虑因素之一（E对）。